某男，65岁。患冠心病5年，刻下胸闷、心前区疼痛。证属寒凝气滞、心脉不通，宜选用的成药是
A. 心可舒胶囊
B. 通心络胶囊
C. 益心舒胶囊
D. 冠心苏合胶囊
E. 丹七片

正确答案：D。冠心苏合胶囊

解析：本题考查的是冠心苏合滴丸的主治。患冠心病5年，刻下胸闷、心前区疼痛。证属寒凝气滞、心脉不通，宜选用的成药是冠心苏合胶囊（D对）。冠心苏合滴丸：【主治】寒凝气滞、心脉不通所致的胸痹，症见胸闷、心前区疼痛；冠心病心绞痛见上述证候者。心可舒胶囊（A错）：【主治】气滞血瘀引起的胸闷、心悸、头晕、头痛、颈项疼痛；冠心病心绞痛、高血脂、高血压、心律失常见上述证候者。通心络胶囊（B错）：【主治】心气虚乏、血瘀络阻证所致的冠心病心绞痛，症见胸部憋闷、刺痛、绞痛、固定不移、心悸自汗、气短乏力、舌质紫黯或有瘀斑、脉细涩或结代。亦用于气虚血瘀络阻型中风病，症见半身不遂或偏身麻木、口舌㖞斜、言语不利。益心舒胶囊（C错）：【主治】气阴两虚，瘀血阻脉所致的胸痹，症见胸痛胸闷、心悸气短、脉结代；冠心病心绞痛见上述证候者。丹七片（E错）：【主治】瘀血痹阻所致的胸痹心痛、眩晕头痛、经期腹痛。